氟骨症患者的医学检查中，可能查不到
A. 氟斑牙
B. 骨关节活动障碍
C. 骨骼变形
D. 骨质疏松
E. 骨质硬化

正确答案：A。氟斑牙

解析：本题考查氟骨症患者的医学检查。氟骨症是指长期摄入过量氟化物引起氟中毒并累及骨组织的一种慢性侵袭性全身性骨病。在氟骨症患者的医学检查中，要查出氟骨症的症状，可以通过X线检查、CT、核磁共振等方式，来检查骨骼的变形（C对）情况，查出关节活动障碍（B对）、骨质疏松（D对）和骨质硬化（E对）等症状，以诊断氟骨症。氟斑牙（A错，为本题正确答案）是氟摄入过量对牙齿的影响。